在特定时间范围内，对特定人群中的每一个成员进行的调查或检查，属于调查方法中的
A. 抽样调查
B. 普查
C. 捷径调查
D. 验证病因假设
E. 设立对照组

正确答案：B。普查

解析：普查是指在特定时间范围内，一般为1～2天或1～2周，对特定人群中的每一个成员进行的调查或检查，又称全面调查。掌握“口腔健康状况调查的目的、项目、标准及方法”知识点。